患儿，3岁。近两月来食欲不振，厌恶进食，食而乏味，暖气无酸腐，大便不调，但无酸臭，形体尚可，精神正常，舌质淡红，苔薄白，脉尚有力。其证型是
A. 脾失健运
B. 脾胃气虚
C. 脾胃阴虚
D. 积滞化热
E. 脾胃虚寒

正确答案：A。脾失健运

解析：患儿以食欲不振，厌恶进食为主症，故诊断为厌食。脾为“后天之本”，脾气通于口，脾不和则口不知五味，故见食欲不振，厌恶进食，食而乏味；由于为厌食初期，脾运尚可，故见暖气无酸腐，大便不调，但无酸臭；病情尚未深入，故见形体尚可，精神正常，故其证型为脾失健运证（A对）。脾胃气虚（B错）之厌食，多表现为不思进食，食而不化，大便偏稀夹不消化食物，面色少华，形体偏瘦，肢倦乏力，舌质淡，苔薄白，脉缓无力。脾胃阴虚（C错）之厌食，多表现为不思进食，食少饮多，皮肤失润，大便偏干，小便短黄，甚或烦躁少寐，手足心热，舌红少津，苔少或花剥，脉细数，本病例临床特点与之不符。积滞化热（D错）多表现为里实热证。脾胃虚寒（E错）证多致胃痛隐隐，喜温喜按，舌淡苔白，脉虚弱或迟缓。